中西药联用得当，相互为用，可取长补短，使疗效增强，病程缩短，药物的毒副作用减少。如与西药解痉药联用，既能提高疗效，又能消除西药腹胀、便秘等不良反应的方剂是
A. 补中益气汤
B. 越婢加术汤
C. 芍药甘草汤
D. 补阳还五汤
E. 苓桂术甘汤

正确答案：C。芍药甘草汤

解析：本题考查的是中西药合理联用的举例。中西药联用得当，相互为用，可取长补短，使疗效增强，病程缩短，药物的毒副作用减少。如与西药解痉药联用，既能提高疗效，又能消除西药腹胀、便秘等不良反应的方剂是芍药甘草汤（C对）。芍药甘草汤等与西药解痉药联用，可提高疗效，同时还能消除腹胀、便秘等副作用。补中益气汤（A错）等具有免疫调节作用的中药与抗胆碱酯酶药联用，治肌无力疗效较好。越婢加术汤（B错）等与西药利尿药联用，可以增强利尿效果，可减轻因应用西药利尿药而导致的口渴等副作用。但排钾性利尿药不宜与含甘草类的中药复方联用，以避免乙型醛固酮增多症。补阳还五汤（D错）的药物组成为黄芪、桃仁、红花、赤芍、当归、川芎、地龙。地龙与苯妥英钠等抗癫痫药联用，能提高抗癫痫的效果。黄芪等，与西药化疗药联用，可降低患者因化疗药而导致的白细胞降低等不良反应。苓桂术甘汤（E错）等与普萘洛尔类抗心律失常药联用，既可增强治疗作用，又能预防发作性心动过速；与脑血管疾病用药甲磺酸二氢麦角碱联用，可增强对体位性低血压病的治疗作用。